维持机体新陈代谢所必需的能量，为小儿所特有的是
A. 基础代谢
B. 生长发育所需
C. 食物特殊动力作用
D. 活动所需
E. 排泄损失能量

正确答案：B。生长发育所需

解析：小儿能量需求包括五个方面：1、基础代谢；2、生长发育所需；3、食物特殊动力作用；4、活动所需；5、排泄损失能量。其中生长发育所需的能量为儿童所特有（B对）。